女，38岁。发热腹泻2天。每日排便5～8次。查体：T37.8℃，腹软，左下腹压痛（+）。实验室检查：血WBC11×10⁹/L，中性粒细胞0.72；粪便镜检WBC20/HP，RBC10/HP，潜血（+）。最可能的诊断是
A. 急性肠炎
B. 霍乱
C. 食物中毒
D. 消化道出血
E. 急性细菌性痢疾

正确答案：E。急性细菌性痢疾

解析：患者中年女性，临床症状：发热、腹泻。阳性体征：左下腹压痛。实验室检查：血WBC稍高，中性粒细胞比例增加，粪检红细胞、白细胞阳性。结合临床表现和实验室检查，最可能的诊断是急性细菌性痢疾（E对）。急性肠炎（A错）以恶心、呕吐、腹泻为主要症状，腹痛可不明显。霍乱（B错）腹泻症状更加严重（每日大便数次甚至难以计数，量多，每天2000～4000ml，严重者8000ml以上）。食物中毒（P157）（C错）好发于夏秋季，多有不洁饮食史，常表现为急性起病，同餐人员同时多人起病，粪便镜检白细胞不超过5个/HP等。消化道出血（D错）有呕血或血便，可有周围循环衰竭。